肝内胆管结石的疼痛
A. 阵发性绞痛
B. 持续性疼痛
C. 持续性疼痛阵发性加剧
D. 持续闷胀痛
E. 钻顶样绞痛

正确答案：D。持续闷胀痛

解析：肝内胆管结石症状不如肝外胆管结石严重和典型。位于Ⅰ、Ⅱ级胆管的结石或整个肝内胆管充满结石时，常表现为肝区、胸背部深在的持续性胀痛（D对），常无胆绞痛和黄疸；位于Ⅱ、Ⅲ级胆管结石，平时只有肝区不适或轻微疼痛；位于周围胆管的小结石，平时可无症状。阵发性绞痛（A错）常见于胆囊结石（P439），其主要表现为胆绞痛，位于右上腹或上腹部，呈阵发性或者持续性疼痛伴阵发性加剧。持续性疼痛（B错）常见于急性胰腺炎（P457），其主要表现为腹痛多位于左上腹，疼痛剧烈，呈持续性，可向左肩及左腰背部放射。持续性疼痛阵发性加剧（C错）常见于急性胆囊炎（P443），其主要表现为上腹部疼痛，开始时仅有上腹胀痛不适，逐渐发展至阵发性绞痛；疼痛放射到右肩、肩胛和背部。钻顶样绞痛（E错）常见于胆道蛔虫症（P447），其主要表现为突发剑突下钻顶样剧烈绞痛，阵发性加剧。